除另有规定外，应检査融变时限的片剂是
A. 咀嚼片
B. 阴道片
C. 泡腾片
D. 口崩片
E. 分散片

正确答案：B。阴道片

解析：本题考查的是片剂的质量要求。除另有规定外，应检査融变时限的片剂是阴道片（B对）。片剂的质量要求：（1）重量差异：每片重量与平均片重或标示片重相比较，超出重量差异限度的不得多于2片，并不得有1片超出限度1倍。糖衣片的片芯应检查重量差异并符合规定，包糖衣后不再检查重量差异。薄膜衣片应在包薄膜衣后检查重量差异并符合规定。凡规定检查含量均匀度的片剂，一般不再进行重量差异检查。（2）崩解时限：除另有规定外，药材原粉片、浸膏（半浸膏）片、糖衣片、薄膜衣片、化药片、中药片、含片、舌下片、可溶片、口崩片（D错）、肠溶片、结肠定位肠溶片、泡腾片（C错），均需进行崩解时限检查。咀嚼片（A错）、以冷冻干燥法制备的口崩片以及规定检查溶出度、释放度的片剂，一般不再进行崩解时限检查。（3）融变时限：阴道片应检查融变时限。（4）发泡量：阴道泡腾片应检查发泡量。（5）分散均匀性：分散片（E错）照崩解时限检查法检查。（6）脆碎度：除另有规定外，对于非包衣片，应符合片剂脆碎度检查法的要求。采用冷冻干燥法制备的口崩片可不进行脆碎度检查。（7）微生物限度：应符合微生物限度标准各品种项下的规定。凡规定检查杂菌的生物制品片剂，可不进行微生物限度检查。（8）溶出度：分散片、以难溶性原料药物制成的口崩片应进行溶出度检查，并符合各品种项下的规定。（9）释放度：缓释片、控释片和肠溶片以及经肠溶材料包衣的颗粒制成的口崩片应进行释放度检查，并符合各品种项下的规定。此外，片剂的鉴别、检查、含量测定、溶出度以及小剂量药物片剂的含量均匀度均应符合各品种项下的有关规定。必要时，薄膜包衣片剂应检查残留溶剂。